注入下腔静脉的是
A. 右腰升静脉
B. 左腰升静脉
C. 右睾丸静脉
D. 左睾丸静脉
E. 肠系膜下静脉

正确答案：C。右睾丸静脉

解析：右睾丸静脉（C对）以直角注入下腔静脉。左睾丸静脉（D错）以锐角注入左肾静脉。